不受动眼神经支配的肌肉有
A. 瞳孔括约肌
B. 瞳孔开大肌
C. 睫状肌
D. 上直肌
E. 上睑提肌

正确答案：B。瞳孔开大肌

解析：动眼神经含一般躯体运动纤维和一般内脏运动（副交感）纤维。一般躯体运动纤维支配上睑提肌（E错）、上直肌（D错）、下直肌、内直肌、下斜肌；副交感纤维支配瞳孔括约肌（A错）、睫状肌（C错）。瞳孔开大肌（B对）由交感中枢发出纤维支配，不受动眼神经支配。